根据《中共中央、国务院关于深化医药卫生体制改革的意见》，建议国家
A. 对基本药物实施公开招标采购，统一配送
B. 对国家基本药物实行全国统一采购价格
C. 县级以上医院应全部配备和使用国家基本药物
D. 基本药物全部纳入基本医疗保障药品报销目录
E. 基本药物报销比例要明显更高于非基本药物报销比例

正确答案：A、D、E。对基本药物实施公开招标采购，统一配送；基本药物全部纳入基本医疗保障药品报销目录；基本药物报销比例要明显更高于非基本药物报销比例

解析：本题考查的是《中共中央、国务院关于深化医药卫生体制改革的意见》。根据《中共中央、国务院关于深化医药卫生体制改革的意见》，建议国家对基本药物实施公开招标采购，统一配送（A对）、基本药物全部纳入基本医疗保障药品报销目录（D对）、基本药物报销比例要明显更高于非基本药物报销比例（E对）。建立健全药品供应保障体系。加快建立以国家基本药物制度为基础的药品供应保障体系，保障人民群众安全用药建立国家基本药物制度。中央政府统一制定和发布国家基本药物目录，按照防治必需、安全有效、价格合理、使用方便、中西药并重的原则，结合我国用药特点，参照国际经验，合理确定品种和数量。建立基本药物的生产供应保障体系，在政府宏观调控下充分发挥市场机制的作用，基本药物实行公开招标采购，统一配送，减少中间环节，保障群众基本用药。国家制定基本药物零售指导价格，在指导价格内，由省级人民政府根据招标情况确定本地区的统一采购价格（B错）。规范基本药物使用，制定基本药物临床应用指南和基本药物处方集。城乡基层医疗卫生机构应全部配备、使用基本药物，其他各类医疗机构也要将基本药物作为首选药物并确定使用比例（C错）。基本药物全部纳入基本医疗保障药物报销目录，报销比例明显高于非基本药物。